无菌产品主要包括
A. 冲剂
B. 眼用制剂
C. 酊水剂
D. 注射剂
E. 软膏剂

正确答案：B、D。眼用制剂；注射剂

解析：本题考查无菌制剂的分类。灭菌制剂与无菌制剂主要是指直接注入体内或直接接触创面、黏膜的一类制剂。由于这类制剂直接进入人体血液系统，在使用前必须保证处于无菌状态。无菌制剂主要包括眼用制剂（B对）、注射剂（D对）、植入型制剂、局部外用制剂及手术中使用的制剂，如冲洗剂、止血海绵剂等。冲剂（A错）是指药材的提取物加适量赋形剂或部分药材细粉制成干燥颗粒状或块状的内服药剂，不属于无菌产品。酊水剂（C错）又称酊剂，是指饮片用规定浓度的乙醇提取或溶解制成的澄清液体制剂，供口服或外用，不属于无菌制剂。软膏剂（E错）指药物与油脂性或水溶性基质混合制成均匀的半固体外用制剂。用于烧伤、严重创伤的软膏剂应无菌。